不属于卫生行政部门对医疗机构诊疗活动超出登记范围的处罚
A. 没收非法所得
B. 警告
C. 责令其改正
D. 情节严重的，吊销其《医疗机构执业许可证》
E. 可以根据情节处以3000元以下的罚款

正确答案：A。没收非法所得